下列有关干槽症的治疗方法中，除外
A. 清创
B. 隔离外界刺激
C. 促进肉芽组织生长
D. 局部止血药物
E. 抗炎、止痛

正确答案：D。局部止血药物

解析：本题考查牙拔除术并发症。干槽症治疗方法：清创（A对），隔离外界刺激（B对），促进肉芽组织生长（C对），抗炎、止痛（E对）。干槽症患者拔牙窝空虚，血液供应不良，所以局部止血（D错，为本题正确答案）是不正确的。